治疗咽喉疼痛应首选
A. 少商
B. 少泽
C. 中冲
D. 隐白
E. 大敦

正确答案：A。少商

解析：少商是手太阴肺经井穴，可以治疗肺经的热证，此穴可清肺利咽开窍，用于治疗咽喉疼痛（A对）。少泽（B错）主治乳痈、乳少等乳疾；昏迷、热病等急症、热证；头痛、目痛、咽喉肿痛等头面五官病证。中冲（C错）主治中风昏迷、舌强不语、中暑、昏厥、小儿惊风等急症；热病，舌下肿痛。隐白（D错）主治月经过多、崩漏等妇科病；便血、尿血等慢性出血证；癫狂，多梦；惊风；腹满，暴泻。大敦（E错）主治疝气，少腹痛；遗尿、癃闭、五淋、尿血等泌尿系病证；月经不调、崩漏、阴缩、阴中痛、阴挺等月经病及前阴病证；癫痫。